呼吸链电子传递过程中可直接被磷酸化的物质是
A. CDP
B. ADP
C. GDP
D. TDP
E. UDP

正确答案：B。ADP

解析：本题考查氧化磷酸化。呼吸链电子传递过程中可直接被磷酸化的物质是ADP（B对ACDE错）。电子传递过程中释放的能量使ADP磷酸化是ATP生成的主要方式。呼吸链电子传递的氧化过程与ADP磷酸化，生成ATP相偶联的过程称氧化磷酸化。